女，40岁，发现右乳肿物1年，病初约花生米大小，近半年肿物增大，无特殊不适。查体：右乳外上限可触及4cm×3cm质硬肿物，皮肤无粘连。右侧腋窝淋巴结可触及肿大、质硬淋巴结，融合成团，右侧锁骨上淋巴结未触及。乳房x线摄影：右乳可见4cm×3cm高密度影，周边成毛刺状，中央可见强回声钙化点。其余检查未见远处转移。该患者疾病TNM分期为
A. T2N2M0
B. T3N2M0
C. T3N1M0
D. T2N1M0
E. T1N2M0

正确答案：A。T2N2M0

解析：根据题干：右乳外上限可触及4cm×3cm质硬肿物属于T2。右侧腋窝淋巴结可触及肿大、质硬淋巴结，融合成团属于N2。其余检查未见远处转移属于M0。所以该患者疾病TNM分期为T2N2M0（A对）。